妊高征孕妇伴脑水肿时首选药物是
A. 硫酸镁
B. 派替啶
C. 肼苯哒嗪
D. 阿托品
E. 甘露醇

正确答案：E。甘露醇

解析：妊高征孕妇伴脑水肿时首选药物是甘露醇（E对），可以迅速降低颅内压。硫酸镁（P71）（A错）通过抑制运动神经末梢释放乙酰胆碱，阻断神经肌肉接头间的信息传递，使骨骼肌松弛，是治疗子痫和预防复发的首选药物；肼苯哒嗪（肼屈嗪）（八年制妇产科学第2版P83）（C错）为妊娠高血压疾病的常用药物，主要作用于血管舒缩中枢或直接作用于小动脉平滑肌，可快速降压；阿托品（P384）（D错）能抑制胆碱能纤维，拮抗迷走神经过度兴奋，主要用于治疗人工流产综合反应严重者，三者均无治疗脑水肿的作用。派替啶（P70）（B错）为冬眠合剂的组分之一，可广泛抑制神经系统，有助于解痉降压，但会使血压急剧下降，导致肾及子宫胎盘血供减少，导致胎儿缺氧，仅用于硫酸镁治疗效果不佳者。